使物料在定子和转子间受剪切、被粉碎的设备是
A. 球磨机
B. 冲击式粉碎机
C. 滚压式粉碎机
D. 胶体磨
E. 气流式粉碎机

正确答案：D。胶体磨

解析：本题考查胶体磨的特点。胶体磨（D对）为湿法粉碎机，典型的胶体磨由定子（stator）和转子（rotor）组成，转子高速旋转，物料在对接在一起的定子和转子间的缝隙中受剪切力的作用而被粉碎成胶体状。